堤平面与上唇下缘的关系是
A. 唇上2mm
B. 与唇平齐
C. 唇下2mm
D. 唇下3mm
E. 唇下4mm

正确答案：C。唇下2mm

解析：本题考查堤平面与上唇下缘的关系。堤平面是全口义齿制作过程中记录（牙合）平面的，确定颌位关系时，将蜡片考软，卷成8～10mm的蜡条，按牙槽嵴外形粘在基托上，引入口内趁蜡堤还软以（牙合）平面规按压其表面，所形成的（牙合）平面。堤平面在上唇下缘下2mm（C对），若堤平面在上唇下缘超过2mm（DE错），全口义齿修复后会出现露龈笑，影响义齿修复的美观。若堤平面在上唇下缘不足2mm（AB错），全口义齿修复后，微笑时，牙齿露出过少，面部比例不协调，义齿修复的不够自然。